既能润肠通便，又能利水消肿的药物是
A. 知母
B. 杏仁
C. 决明子
D. 郁李仁
E. 火麻仁

正确答案：D。郁李仁

解析：该题考查郁李仁的功效，属记忆内容。郁李仁味辛、苦、甘；性平；入脾、大肠、小肠经；具有润肠通便，利水消肿的功效（D对）。知母具有清热泻火，滋阴润燥的功效（A错）。杏仁具有止咳平喘，润肠通便的作用（B错）。决明子为清热泻火药，具有清热明目，润肠通便的功效（C错）。火麻仁具有润肠通便的功效（E错）。